下列关于下颌运动影响因素的描述，正确的是
A. 右侧颞下颌关节是影响下颌运动解剖性因素
B. 左侧颞下颌关节是影响下颌运动解剖性因素
C. （牙合）因素是影响下颌运动解剖性因素
D. 神经肌肉因素是一个因受牙周、关节囊及关节韧带等多种结构中感受器的反馈调节作用而灵活多变的因素
E. 以上说法均正确

正确答案：E。以上说法均正确

解析：下颌运动受以下四个因素的影响，即：①右侧颞下颌关节；②左侧颞下颌关节；③（牙合）；④神经肌肉因素。其中，第①、②两个制约因素即双侧颞下颌关节是解剖性因素，相对固定，一般情况下不会改变，对下颌运动的范围和方式有重要制约作用；第③因素也属解剖性因素，可在一定范围内因自然的变化（如生理性磨耗和病理性磨损）与医源性改变（如充填、修复、正畸、（牙合）重建等）而发生变化；第④因素是一个因受牙周、关节囊及关节韧带等多种结构中感受器的反馈调节作用而灵活多变的因素。掌握“下颌运动的制约因素及记录方法”知识点。